配制10%葡萄糖注射液500ml，现用50%和5%葡萄注射液混合，应当分别量取
A. 50%葡萄糖注射液56ml和5%葡萄糖注射液444ml
B. 50%葡萄糖注射液72ml和5%葡萄糖注射液428ml
C. 50%葡萄糖注射液85ml和5%葡萄糖注射液415ml
D. 50%葡萄糖注射液94ml和5%葡萄糖注射液406ml
E. 50%葡萄糖注射液106ml和5%葡萄糖注射液394ml

正确答案：A。50%葡萄糖注射液56ml和5%葡萄糖注射液444ml

解析：本题考查两种浓度混合的换算。两种浓度混合的换算可应用交叉法计算：C₁×A+C₂×B=C₃（A+B）。其中C₁为浓溶液浓度；C₂为稀溶液浓度；C₃为混合溶液浓度；A为浓溶液体积；B为稀溶液体积。取50%葡萄糖注射液Aml，则取5%葡萄糖注射液（500-A）ml；10%×500ml=50%×Aml+5%（500-A）ml，解得A=56ml，500-A=444ml，故50%葡萄糖注射液56ml和5%葡萄糖注射液444ml（A对）。